阴囊包块，透光试验阴性，平卧后消失，多见于
A. 睾丸鞘膜积液
B. 精索鞘膜积液
C. 交通性鞘膜积液
D. 腹股沟斜疝
E. 睾丸肿瘤

正确答案：D。腹股沟斜疝

解析：阴囊包块，透光试验阴性，平卧后消失，多见于腹股沟斜疝（D对）。由于疝内容物多为肠管、肠系膜和大网膜，而非液体，因此透光试验阴性。睾丸鞘膜积液（A错）的阴囊包块平卧后不消失；交通性鞘膜积液（C错）的肿块卧位后可消失，两者透光试验均为阳性。精索鞘膜积液（B错）表现为腹股沟管内较小的肿块，牵拉同侧睾丸可见肿块移动。睾丸肿瘤（E错）的典型表现为睾丸肿胀或变硬，透光试验阴性。